下列乙类传染病应按甲类传染病处理的是
A. 流行性出血热
B. 流行性乙型脑炎
C. 肺炭疽
D. 流行性脑脊髓膜炎
E. 布氏杆菌病

正确答案：C。肺炭疽